天疱疮疱的形成机制是
A. 棘层内疱
B. 棘层松解
C. 角化不良
D. 异常增生
E. 基层下疱

正确答案：B。棘层松解

解析：棘层松解是由于上皮棘层细胞间张力原纤维及黏合物质发生变性、断裂破坏，细胞间桥溶解，而使棘细胞间联系力松弛、断裂，严重时失去联系、解离，则在棘层形成裂隙或疱，此为天疱疮的典型表现。掌握“口腔黏膜基本病理变化”知识点。